豆类的抗营养因素不包括下列哪一项
A. 蛋白酶抑制剂
B. 抗生物素
C. 皂苷
D. 植酸
E. 植物红细胞凝集素

正确答案：B。抗生物素

解析：大豆中的抗营养因素： （1） 蛋白酶抑制剂 （PI）生豆粉中含有此种因子，对人胰蛋白酶 活性有部分抑制作用，对动物生长可产生一定影响。 （2）豆腥味主要是脂肪酶的作用。95℃以上加热10~15min等方法可脱去部分豆腥味。 （3）胀气 因子主要是大豆低聚糖 的作用。 （4）植酸 影响矿物质吸收。 （5）皂苷 和异黄酮此两类物质有抗氧化、降低血脂和血胆固醇的作用，近年来的研究发现了其更多的保健功能。 （6）植物红细胞凝集素 为一种蛋白质。可影响动物生长。加热即被破坏。